下列除哪项外，均是舌颤动的病因
A. 气血两虚
B. 亡阴伤津
C. 热极生风
D. 酒毒所伤
E. 心脾有热

正确答案：E。心脾有热

解析：舌为心之苗，脾开窍于口，心脾有热，所以舌常伸出于口外，多见吐弄舌（E错，为本题正确答案）。气血两虚（A对），舌体筋脉失于濡养而无力平稳伸展舌体故舌颤动。因热极，亡阴伤津（B对）而产生动风、肝阳化风等，皆可出现舌颤动。新病舌绛而颤动者，多属热极生风（C对）。酒毒内蕴（D对），亦可出现舌体颤动。